患者头微痛，恶寒无汗，咳嗽痰稀鼻塞嗌干，舌苔白，脉弦。治疗应首选
A. 杏苏散
B. 麻黄汤
C. 止嗽散
D. 小青龙汤
E. 桑杏汤

正确答案：A。杏苏散

解析：患者头微痛，恶寒无汗，咳嗽痰稀鼻塞嗌干，舌苔白，脉弦。方用杏苏散，为轻宣凉燥的代表方，亦是治疗风寒咳嗽的常用方。苏叶发表散邪，宣发肺气；杏仁降利肺气，润燥止咳；前胡疏风散邪，降气化痰；桔梗、枳壳理气化痰；半夏、橘皮燥湿化痰，理气行滞；茯苓渗湿健脾；生姜、大枣调和营卫以利解表，滋脾行津以润干燥；甘草调和诸药（A对）。麻黄汤证为外感风寒，肺气失宣所致。为外感风寒证的基础方（B错）。止嗽散方证为外感咳嗽，经服解表宣肺药后而咳仍不止者（C错）。小青龙汤主治外感风寒，寒饮内停之证（D错）。为治疗温燥伤肺轻证的常用方（E错）。趣记：杏苏散，二陈三，更值钱。